《中国药典》一部规定，甘草和黄芪有机氯农药残留量检查包括的种类有
A. 六六六（总BHC）
B. 敌敌畏
C. 滴滴涕（总DDT）
D. 五氯硝基苯
E. 敌百虫

正确答案：A、C、D。六六六（总BHC）；滴滴涕（总DDT）；五氯硝基苯